在中脑上下丘之间切断脑干的动物，将出现
A. 肢体痉挛性麻痹
B. 脊髓休克
C. 去皮层僵直
D. 去大脑僵直
E. 上运动神经元麻痹

正确答案：D。去大脑僵直

解析：在中脑上下丘之间切断脑干的动物，即表现为四肢伸直，坚硬如柱，头尾昂起，脊柱挺硬，呈角弓反张状态，这一现象称为去大脑僵直（D对）。痉挛性麻痹（简称硬瘫）（A错）是上运动神经元损伤（E错）后，临床上常出现的症状。脊髓休克（B错）是当人和动物的脊髓在与高位中枢离断后，反射活动能力暂时丧失而进入无反应状态的现象。去皮层僵直（C错）是当人的蝶鞍上囊肿引起皮层与皮层下结构失去联系时，可出现明显的下肢僵硬及上肢的半屈状态。